患者干咳少痰，痰中带血，潮热盗汗，胸闷隐痛，身体逐渐消瘦，口燥咽干，舌红少苔，脉细数。其诊断是
A. 肺痨
B. 肺痿
C. 咳血
D. 虚劳
E. 肺胀

正确答案：A。肺痨

解析：肺痨的诊断：1.咳嗽、咯血、潮热、盗汗、身体明显消瘦2.常有与肺痨患者的长期接触史（A对）。肺痿是由肺部多种慢性疾患，如肺痈、肺痨、咳嗽等病日久导致肺叶萎弱不用而成，临床以咳吐浊唾涎沫为主症，不具传染性（B错）。咳血，血由肺、气道而来，经咳嗽而出，或觉喉痒胸闷，血色鲜红，或夹泡沫，或痰血相兼，痰中带血，多有慢性咳嗽、痰喘、肺痨等病史。无身体消瘦症状（C错）。虚劳由外感、内伤等诸多病因引起；涉及多个脏腑，以脾肾为主，无传染性，脏腑气血阴阳亏损，久虚不复为其基本病机，临床表现为脏腑气血阴阳亏虚的多种证候（D错）。肺胀是多种慢性肺系疾病反复发作，迁延不愈，导致肺气胀满，不能敛降的一种病证，临床以喘息气促，咳嗽咳痰，胸部膨满，胸闷如塞，或唇甲紫绀，心悸浮肿，甚至出现喘脱、昏迷为主要表现（E错）。